正常体液中酸(H⁺)的主要来源是
A. 食物摄入的酸
B. 代谢过程中产生的碳酸
C. 蛋白分解代谢产生的硫酸、磷酸和尿酸
D. 糖代谢产生的甘油酸、丙酮酸、乳酸和三羧酸
E. 脂肪代谢产生的β—羟丁酸和乙酰乙酸

正确答案：B。代谢过程中产生的碳酸

解析：正常体液中酸(H⁺)的主要来源是代谢过程中产生的碳酸（B对），属于挥发酸。食物摄入的酸（A错），蛋白分解代谢产生的硫酸、磷酸和尿酸（C错），糖代谢产生的甘油酸、丙酮酸、乳酸和三羧酸（D错），脂肪代谢产生的β—羟丁酸和乙酰乙酸（E错）等酸属于固定酸，与每日产生的挥发酸相比要少得多。